玄参的主治病证有
A. 温毒发斑
B. 肠燥便秘
C. 咽喉肿痛
D. 瘰疬痰核
E. 骨蒸潮热

正确答案：A、B、C、D、E。温毒发斑；肠燥便秘；咽喉肿痛；瘰疬痰核；骨蒸潮热

解析：本题考查的是玄参的主治病证。玄参的主治病证有温毒发斑（A对）、肠燥便秘（B对）、咽喉肿痛（C对）、瘰疬痰核（D对）、骨蒸潮热（E对）。玄参：【主治病证】（1）温病热入营血，温毒发斑。（2）热病伤阴之心烦不眠，阴虚火旺之骨蒸潮热。（3）咽喉肿痛，痈肿疮毒，瘰疬痰核，阳毒脱疽。（4）阴虚肠燥便秘。